DIC时机体的功能代谢的变化，下列说法不正确的是
A. 出血
B. 休克
C. 器官功能障碍
D. 失血性贫血
E. 溶血性贫血

正确答案：D。失血性贫血

解析：出血（A对）、休克（B对）、器官功能障碍（C对）和溶血性贫血（E对）是DIC时机体的功能代谢的变化。出血常为DIC患者最初的症状，可有多部位出血，如皮肤瘀斑、紫癜、呕血、黑便、咯血、血尿、牙龈出血、鼻出血及阴道出血等。急性 DIC 时常伴有休克，DIC 和休克可互为因果，形成恶性循环。DIC 时，大量微血栓引起微循环障碍，可导致缺血性器官功能障碍。DIC 患者可出现微血管病性溶血性贫血。失血性贫血（D错，为本题正确答案）不是DIC时机体的功能代谢的变化。